下列除哪项外，均是采录“主诉”所要求的内容
A. 主诉是迫使病人就医的最主要症状
B. 一般不超过20个字
C. 确切的主诉常可作为诊断的向导
D. 主诉的记录，尽量使用诊断术语
E. 症状不突出者，可把就医的主要目的作为主诉

正确答案：D。主诉的记录，尽量使用诊断术语

解析：主诉为患者感受到的最主要的痛苦或最明显的症状和（或）体征（A对），也就是本次就诊最主要的原因及其持续时间，主诉要有显著的意向性，确切的主诉可初步反映病情轻重与缓急，并提供对某系统疾患的诊断线索（C对），尽可能用患者自己的语言，不用医师的诊断用语（D错，为本题正确答案）。主诉应用一，两句话加以概括，并问时注明主诉自发生到就诊的时间，记录主诉要简明，一般不超过20个字（B对），症状不突出者，可把就医的主要目的作为主诉（E对）。